抢救哮喘持续状态宜选用的药物是
A. 沙丁胺醇
B. 哌仑西平
C. 氨茶碱
D. 二丙酸倍氯米松
E. 色甘酸钠

正确答案：C。氨茶碱

解析：氨茶碱可用于β₂受体激动药不能控制的急性哮喘发作，在急性重度哮喘或哮喘持续状态时可采用氨茶碱静脉注射或静脉滴注，以迅速缓解喘息与呼吸困难等症状（C对）。